治疗短暂性脑缺血发作气虚血瘀，脉络瘀阻证，应首选
A. 镇肝熄风汤
B. 补阳还五汤
C. 黄连温胆汤合桃红四物汤
D. 羚角钩藤汤
E. 半夏白术天麻汤

正确答案：B。补阳还五汤

解析：气血双亏，脑窍失养，故见头晕目眩，动则加剧，猝然言语謇涩；血亏不能滋养身体，故见一侧肢体软弱无力，渐觉不遂，偶有肢体掣动，口角流涎，为时短暂，气虚血瘀、脉络瘀阻，故见舌质暗淡，或有瘀点，苔白，脉沉细无力或涩（B对）。镇肝熄风汤可以平肝息风，育阴潜阳。治疗肝肾阴虚、风阳上扰证（A错）。黄连温胆汤合桃红四物可以豁痰化瘀，通经活络。治疗痰瘀互结、阻滞脉络证（C错）。羚角钩藤汤可以凉肝熄风，增液舒筋。治疗肝热生风证（D错）。半夏白术天麻汤可以化痰熄风，健脾祛湿。主治风痰上扰证（E错）。